下列关于脂肪氧化分解过程的叙述，错误的是
A. β-氧化中的受氢体为NAD⁺和FAD
B. 一分子软脂酸完全氧化可净生成127分子ATP
C. 脂肪酰CoA需转运入线粒体
D. 脂肪酸首先要活化生成脂肪酰CoA
E. β-氧化的4步反应为脱氢、加水、再脱氢和硫解

正确答案：B。一分子软脂酸完全氧化可净生成127分子ATP